直接作用于血管平滑肌的抗高血压药物有
A. 哌唑嗪
B. 肼屈嗪
C. 二氮嗪
D. 胍乙啶
E. 硝普钠

正确答案：B、C、E。肼屈嗪；二氮嗪；硝普钠

解析：本题考查抗高血压药。血管扩张药包括直接舒张血管平滑肌药和钾通道开放药。根据对动、静脉选择性差异，分为主要扩张小动脉药（肼屈嗪（B对）、米诺地尔、二氮嗪（C对）等）和对动脉、静脉均有舒张作用药物（硝普钠（E对））。哌唑嗪（A错）为α受体阻断药。胍乙啶（D错）为影响肾上腺素能神经递质药。